对婴幼儿、处于休克状态需要急救等患者适用的模式是
A. 双方冲突型
B. 患者主导型
C. 主动-被动型
D. 指导-合作型
E. 共同参与型

正确答案：C。主动-被动型

解析：主动-被动模式：也可称为支配-服从模式。在这类模式中，医师处于主动或支配地位，病人完全是被动的。一般地说，对于昏迷、手术、婴幼儿或精神病人适用于这一模式。由于病人此时没有主动性，完全听任医务人员的处置，医务人员务必以高度的责任感、高尚的道德和娴熟的技术诊治病人，不得给他们以损害。掌握“医患关系伦理”知识点。